NK细胞是
A. 特殊的T淋巴细胞
B. 吞噬细胞
C. （专职性）抗原提呈细胞
D. 介导ADCC的细胞
E. B淋巴细胞

正确答案：D。介导ADCC的细胞